腹腔内成对脏器的淋巴流经
A. 腹腔淋巴结
B. 肠系膜上淋巴结
C. 肠系膜下淋巴结
D. 髂总淋巴结
E. 腰淋巴结

正确答案：E。腰淋巴结

解析：腹腔内成对脏器注入腰淋巴结(E对）。回结肠淋巴结、右结肠淋巴结和中结肠淋巴结输出淋巴管注入肠系膜上淋巴结（B错）。左结肠淋巴结、乙状结肠淋巴结和直肠上淋巴，结肠系膜下淋巴结输出淋巴管注入肠系膜下淋巴结（C错）。髂总淋巴结（D错）收集骶淋巴结、髂内淋巴结和髂外淋巴结。